某男，20岁，因饮食不洁导致痢疾，症见大便脓血里急后重，发热腹痛，舌淡红，苔黄腻，脉滑数。医师诊为大肠湿热，处方为黄连、木香，水煎服。方中黄连配伍木香除清热燥湿外，又能
A. 理气止痛
B. 缓急止痛
C. 涩肠止痢
D. 活血止痛
E. 杀虫止痢

正确答案：A。理气止痛

解析：本题考查的是黄连的配伍。方中黄连配伍木香除清热燥湿外，又能理气止痛（A对）。黄连：【配伍】黄连配木香：黄连苦寒，功能清热燥湿、泻火解毒；木香辛苦性温，功能理肠胃气滞而止痛。两药相配，既清热燥湿解毒，又理气止痛，治湿热泻痢腹痛、里急后重每用。黄连配吴茱萸：黄连苦寒，功能消热燥湿泻火；吴茱萸辛苦而热，功能燥湿疏肝下气。两药相配，既清热泻火燥湿，又疏肝和胃制酸，治肝火犯胃、湿热中阻之呕吐泛酸。黄连配半夏、瓜蒌：黄连苦寒，功能清热燥湿泻火；半夏辛苦而温，功能燥温化痰、消痞散结；瓜蒌甘寒，功能消热化痰、利气宽胸。三药相配，既泻火化痰，又消散痞结，治痰火互结之结胸证效佳。甘草：【功效】益气补中，祛痰止咳，解毒，缓急止痛（B错），缓和药性。乳香：【功效】活血止痛（D错），消肿生肌。仙鹤草：【功效】收敛止血，止痢，截疟，解毒，杀虫（E错），补虚。功效为涩肠止痢（C错）的中药，2022年考试指南未明确说明。